以下数字修约后要求保留三位有效数字：1.2351
A. 1.24
B. 1.23
C. 1.21
D. 1.22
E. 1.2

正确答案：A。1.24